消毒并不是为了
A. 将病原微生物消灭于外环境中
B. 切断传播途径
C. 阻断传染病播散
D. 杀灭所有微生物
E. 控制医院感染

正确答案：D。杀灭所有微生物